鉴别未分化癌和肉瘤有帮助的标记物
A. 细胞角蛋白
B. 淀粉酶
C. alponin
D. CEA
E. S-100蛋白

正确答案：A。细胞角蛋白

解析：本题考查恶性肿瘤的鉴别。鉴别未分化癌和肉瘤有帮助的标记物为细胞角蛋白（A对）。细胞角蛋白为肿瘤标志物，可用于鉴别未分化癌和肉瘤。